“通调水道”依赖肺的哪项功能
A. 主治节
B. 朝百脉
C. 主宣发肃降
D. 司呼吸之气
E. 主一身之气

正确答案：C。主宣发肃降

解析：该题考查肺的生理功能。肺主通调水道，出自《素问·经脉别论》，指通过肺气宣发肃降对体内水液的输布、运行和排泄具有疏通和调节作用。作用机理：一是肺气宣发，将脾转输至肺的津液，向上向外布散，上至头面诸窍，外达皮毛肌腰，并化为汗液排出体外；二是肺气肃降，将脾转输至肺的津液，向下向内布散，下输于肾，成为尿液生成之源（C对）。肺主一身之气和司呼吸之气都取决于肺的呼吸功能（DE错）。肺朝百脉，指全身的血液，都要通过经脉而会聚于肺，经肺的呼吸进行气体交换，而后输布于全身，即肺气助心行血的生理功能（B错）。肺对气、血、津液的治理和调节作用，称为“肺主治节”（A错）。